下列通用名与别名的组合中，不是同一种药品的是
A. 醋酸氯己定与洗必泰
B. 利可君与利血生
C. 桂利嗪与脑益嗪
D. 氨甲苯酸与止血敏
E. 他莫昔芬与三苯氧胺

正确答案：D。氨甲苯酸与止血敏

解析：本题考查药品通用名与别名。氨甲苯酸为通用名，其对应的别名为止血芳酸。止血敏为别名，其对应的通用名为酚磺乙胺（D错，为本题正确答案）。醋酸氯己定与洗必泰（A对）、利可君与利血生（B对）、桂利嗪与脑益嗪（C对）、他莫昔芬与三苯氧胺（E对）的通用名与别名一一对应，是同一种药品。